在上运动神经元和感觉完好情况下，右上腹壁反射消失提示
A. 右侧胸髓3～4节段病损
B. 右侧胸髓5～6节段病损
C. 右侧胸髓7～8节段病损
D. 右侧胸髓9～10节段病损
E. 右侧胸髓11～12节段病损

正确答案：C。右侧胸髓7～8节段病损